医疗机构发现甲类传染病应采取下列措施，除外
A. 对患者予以隔离治疗
B. 对疑似患者，确诊前在指定场所单独隔离治疗
C. 对医疗机构内的患者的密切接触者，在指定场所进行医学观察和采取其他必要的预防措施
D. 拒绝隔离治疗的，可以由公安机关协助采取强制隔离治疗措施
E. 采取紧急措施并予以公告

正确答案：E。采取紧急措施并予以公告